男，16岁，发热4天伴纳差2天急诊。检查：血压114/70mmHg，左脚拇趾甲沟部红肿破溃，血白细胞计数为20×10⁹/L，中性粒细胞为89%。经处理3天后病人体温升高，且血压和血小板计数下降，此时病人可能合并有
A. 败血症
B. DIC
C. 感染性休克
D. 多器官衰竭
E. 菌血症

正确答案：A。败血症

解析：败血症现改称脓毒症，常表现寒战、高热、脉搏细速、血压下降、血小板减少（三版8年制外科学P168，8版外科学未讲述）。根据题干，本例应诊断为败血症。弥散性血管内凝血 (DIC） 的诊断标准为下列5项中出现3项以上：血小板计数<80×l0 ⁹ / L、凝血酶原时间延长3s以上、血浆纤维蛋白原 <1.5g/L、3P试验阳性、血涂片中破碎红细胞>2%。患者虽有血压降低，但没有给出降低后的血压值，不能诊断为感染性休克。多器官功能衰竭常有两个以上的器官功能不全，与题干所述不符。菌血症是指血培养检出病原菌的脓毒症，但题干未给出血培养结果。